质量调整生存年可以综合反映人群的
A. 期望寿命和生存年数
B. 健康状态和期望寿命
C. 生命质量和生存数量
D. 健康状态和生存能力
E. 危险因素和疾病构成

正确答案：C。生命质量和生存数量

解析：本题考查质量调整生存年的意义。质量调整生存年可以综合反映人群的生命质量和生存数量（C对ABDE错）。